2008年共发生200例某病病人，在2008年年初已知有800例病人，年内因该病死亡40例，年中人口数1000万，如果该病的发生和因该病死亡的事件均匀分布在全年中，则2008年期间该病的患病率（1/10万）是
A. 2.0
B. 8.0
C. 10
D. 1.6
E. 0.4

正确答案：C。10

解析：本题考查患病率。2008年共发生200例某病病人，在2008年年初已知有800例病人，年内因该病死亡40例，年中人口数1000万，如果该病的发生和因该病死亡的事件均匀分布在全年中，则2008年期间该病的患病率（1/10万）是10（C对）。患病率是指某特定时间内总人口中某病新旧病例之和所占的比例。患病率可按观察时间的不同分为期间患病率和时点患病率两种。患病率=（特定时间点某人群中某病的新旧病例数/同期观察人口）✕K，其中K=100%、1000‰、10000/万或100000/10万等。患病率=（200+800）/100✕100000/10万=10。